晚期难免流产一旦诊断明确，应首先采取的措施是
A. 刮宫
B. 输血
C. 催产素肌注或静滴
D. 生化汤煎服
E. 抗生素肌注或静滴

正确答案：A。刮宫

解析：难免流产即胎堕难留者，要“速去其胎，以救其母”，进行清宫术是为了尽快全部清除残留在宫内的胚胎组织物，减少阴道流血及感染对母体的不良影响，尤其要防止阴血暴下，气随血脱之危象（A对）。输血一般用于难免流产所造成的大出血或失血性休克（B错）。催产素肌注或静滴一般为晚期难免流产清宫术时，促使胎儿排出体外（C错）。生化汤煎服可用于治疗胎堕难留者，若服药后殒胎不下，须立即行清宫术，但为保证母体安全，一般多直接进行清宫术（D错）。抗生素肌注或静滴多用于术后的抗感染治疗（E错）。